冰岛居民习惯于熏羊肉作为主食，当地的胃癌发病率一直居高不下。至1950年以后，由于减少自制熏制食品的食用，发病率呈下降趋势，这可能是与熏羊肉受到了哪一类污染有关
A. B（a）P
B. 食品防腐剂
C. 二甲基亚硝胺
D. 黄曲霉毒素
E. RHA

正确答案：A。B（a）P